联合卡环适用于
A. 单个前牙缺失
B. 双侧后牙缺失
C. 前后牙缺失
D. 单侧缺牙
E. 单侧个别牙缺失

正确答案：D。单侧缺牙

解析：本题考查局部义齿固位体。联合卡环：由两个卡环通过共同的卡环体连接而成。卡环体位于相邻两基牙的（牙合）外展隙，并与伸向（牙合）面的（牙合）支托相连接。适用于单侧缺牙（D对），基牙牙冠短而稳固，或相邻两牙之间有间隙者，联合卡环还可用于防止食物嵌塞。